在未服抗高血压药物情况下，18岁以上成年人高血压为
A. 收缩压≥120mmHg和（或）舒张压≥70mmHg
B. 收缩压≥120mmHg和（或）舒张压≥85mmHg
C. 收缩压≥120mmHg和（或）舒张压≥90mmHg
D. 收缩压≥140mmHg和（或）舒张压≥70mmHg
E. 收缩压≥140mmHg和（或）舒张压≥90mmHg

正确答案：E。收缩压≥140mmHg和（或）舒张压≥90mmHg

解析：18岁以上成年人高血压定义为：在未服抗高血压药物情况下，收缩压≥140mmHg和（或）舒张压≥90mmHg。掌握“原发性高血压”知识点。